降低孕产妇死亡率及围生儿死亡率属于
A. 孕期保健
B. 生育期保健
C. 产时保健
D. 哺乳期保健
E. 围婚保健

正确答案：B。生育期保健

解析：降低孕产妇死亡率及围生儿死亡率属于生育期保健（B对），其主要是维护生殖功能的正常，保证母婴安全。孕期保健（A错）分为妊娠早、中、晚期保健，每期侧重点都不同。产时保健（C错）是整个妊娠安全的关键，提倡住院分挽，高危孕妇应提前入院。哺乳期保健（D错）是指产后产妇用自己乳汁喂养婴儿的时期，通常为1年，为保护母婴健康，降低婴幼儿死亡率，保护、促进和支持母乳喂养是哺乳期保健的中心任务。第九版妇产科学未找到有围婚期的概念（E错），目前通用的是婚前保健，是为即将婚配的妇女在结婚登记前提供的保健服务，包括婚前医学检查、婚前卫生指导和咨询，为保障生殖健康、健康生育、减少严重遗传性疾病儿出生，达到母婴健康，亦为优生优育，计划生育提供了保证